初级卫生保健的内容不包括
A. 促进健康
B. 预防疾病
C. 预测疾病
D. 康复服务
E. 治疗疾病

正确答案：C。预测疾病

解析：本题考查初级卫生保健的内容。初级卫生保健的内容包括：①针对当前流行的卫生问题及其预防控制方法开展宣传教育；②促进食品供应和适当的营养（A对）；③供应充足的安全饮用水和基本卫生设施；④妇女儿童保健，包括计划生育；⑤针对主要传染病开展免疫接种；⑥预防和控制地方病（B对）；⑦常见病和伤害的妥善治疗（E对）和管理；⑧提供基本药物（D对）。预测疾病（C错，为本题正确答案）不属于初级卫生保健的内容。